当放射性核素¹⁴C、¹⁵N同时标记的天冬氨酸进入动物体内时，有部分化合物将存在标记原子。下列哪种化合物可能同时存在¹⁵N、¹⁴C
A. 尿素
B. 肾上腺素
C. AMP
D. UMP
E. 肌酸

正确答案：D。UMP